关于致病菌致病因素的描述，错误的是
A. 黏附因子与致病有关
B. 荚膜、微荚膜与致病有关
C. 细菌的胞外酶可致病
D. 内、外毒素与致病有关
E. 细菌侵入数量与致病无密切关系

正确答案：E。细菌侵入数量与致病无密切关系